某女，40岁。患风湿痹痛3年，近日见乳痈肿痛，治当祛风通络、化痰解毒，宜选用的药物是
A. 丝瓜络
B. 臭梧桐
C. 香加皮
D. 络石藤
E. 雷公藤

正确答案：A。丝瓜络

解析：本题考查的是丝瓜络的功效。患风湿痹痛3年，近日见乳痈肿痛，治当祛风通络、化痰解毒，宜选用的药物是丝瓜络（A对）。丝瓜络：【功效】祛风通络，化痰解毒。臭梧桐（B错）：【功效】祛风湿，通经络，降血压。香加皮（C错）：【功效】祛风湿，强筋骨，利水消肿。络石藤（D错）：【功效】祛风通络，凉血消肿。雷公藤（E错）：【功效】祛风除湿，活血通络，消肿止痛，杀虫解毒。